慢性肾功能衰竭的发病机制中不包括
A. 健存肾单位进行性减少
B. 肾小管一间质损害
C. 肾毒物
D. 矫枉失衡
E. 肾小管肥大或萎缩

正确答案：C。肾毒物

解析：慢性肾功能衰竭的发病机制包括健存肾单位进行性减少（A对）、矫枉失衡（D对）、肾小管一间质损害（B对）、肾小管肥大或萎缩（E对）等，而肾毒物（C错，为本题正确答案）引起急性肾衰竭。